按传播途径的不同，病毒性肝炎可分成以下两类
A. 甲、乙型肝炎一类，其他另一类
B. 乙、丙型肝炎一类，其他另一类
C. 甲、丙型肝炎一类，其他另一类
D. 丙、丁型肝炎一类，其他另一类
E. 甲、戊型肝炎一类，其他另一类

正确答案：E。甲、戊型肝炎一类，其他另一类

解析：本题考查病毒性肝炎的分类。按传播途径的不同，病毒性肝炎可分成两大类：一类为经肠道传播的病毒性肝炎，主要经粪-口途径传播，包括甲型和戊型肝炎，其发病有一定的季节性，可引起暴发及流行，感染后多为急性，呈自限性；另一类为经肠道外传播的病毒性肝炎，主要通过血液传播，包括乙型、丙型和丁型肝炎（E对ABCD错），多为散发，但也可见医源性或特殊高危人群中暴发，无季节性，感染后易转为慢性肝炎，部分病例可发展成肝硬化和肝细胞癌。